男，33岁，15年前曾发现蛋白尿，一直未检查和治疗。三周前出现恶心呕吐，查：血压190/120mmHg，轻度浮肿，血肌酐360μmol/L，B超双肾缩小。下述生化异常不应出现的是
A. 高血钾
B. 低血钙
C. 低血钠
D. 低血磷
E. 酸中毒

正确答案：D。低血磷

解析：该患者初步诊断为慢性肾衰竭，慢性肾衰竭常出现各种电解质代谢紊乱和酸碱平衡失调，常见的有：①由于肾小管分泌H⁺障碍或HCO3⁻重吸收能力下降、酸性代谢产物排泄障碍，导致代谢性酸中毒（E对）；②由于肾脏排泄功能下降，水、钠潴留，引起稀释性低血钠（C对）；③由于肾脏功能减退，肾小球滤过率降低，肾脏排钾能力下降，易出现高血钾（A对）；④由于钙摄入不足、活性维生素D缺乏、代谢性酸中毒等，导致钙缺乏，钙缺乏明显时出现低血钙（B对）；⑤由于肾小球滤过率下降、尿磷排出减少，导致高血磷（D错，为本题正确答案）。